上斜肌使瞳孔转向
A. 上内方
B. 下内方
C. 上外方
D. 下外方
E. 以上都不是

正确答案：D。下外方

解析：上斜肌使瞳孔转向下外方（D对）；上直肌使瞳孔转向上内方（A错）；下直肌使瞳孔转向下内方（B错）；下斜肌使瞳孔转向上外方（C错）。